回归热常见于
A. 败血症
B. 伤寒
C. 布鲁菌病
D. 疟疾
E. 霍奇金淋巴瘤

正确答案：E。霍奇金淋巴瘤

解析：本题考查热型及临床意义。回归热常见于回归热、霍奇金淋巴瘤（E对）等。败血症（A错）常见热型为弛张热。伤寒（B错）常见热型为稽留热。布鲁菌病（C错）常见热型为波状热。疟疾（D错）常见热型为间歇热。